对肱三头肌的描述，正确的是
A. 长头起自盂上结节
B. 内、外侧头分别起自桡神经沟上、下方
C. 止于尺骨冠突
D. 能伸肘、伸肩并内收
E. 以上都对

正确答案：D。能伸肘、伸肩并内收

解析：肱三头肌的长头起自盂下结节，而非盂上结节（A错），内、外侧头分别起自桡神经沟下、上方，而非上、下方（B错），止于尺骨鹰嘴，而非尺骨冠突（C错），能伸肘、伸肩并内收（D对）。